铰链位时下颌依此为轴可转动
A. 5～8mm
B. 8～15mm
C. 10～18mm
D. 10～25mm
E. 18～25mm

正确答案：E。18～25mm

解析：正中关系是一个稳定而可重复的位置，是一个功能性的后退边缘位，髁突在正中关系位时，又称为铰链位，下颌依此为轴可做18～25mm转动（切点测量），为铰链开闭口运动，称为正中关系范围。掌握“牙尖交错位、后退接触位与正中关系”知识点。